在一份有关膀胱癌与吸烟关系的前瞻性队列研究中，发现男性吸烟者膀胱癌发病率为48.0/10万，不吸烟者为25.4/10万，其归因危险度百分比为
A. 0.5292
B. 0.4708
C. 0.8898
D. 0.4304
E. 无法计算

正确答案：B。0.4708

解析：本题考查归因危险度百分比的计算。归因危险度百分比是指暴露人群中的发病或死亡归因于暴露的部分占全部发病或死亡的百分比。计算为＝（48.0/10万－25.4/10万）/（48.0/10万）×100%＝47.08%（B对ACDE错）